对爆发性肝炎评价临床抢救效果时最恰当的指标应是
A. 死亡率
B. 发病率
C. 患病率
D. 病死率
E. 罹患率

正确答案：D。病死率

解析：本题考查评价急性传染病诊治的指标。评价爆发性肝炎抢救效果属于考察急性传染病的诊治水平和医疗水平的评价指标。病死率（D对ABCE错）可反映医疗水平和诊治能力，常用于急性传染病的评价。